常规体检发现，7个月小儿头部为方颅，属于维生素D缺乏性佝偻病的
A. 潜伏期
B. 初期
C. 活动期
D. 恢复期
E. 后遗症期

正确答案：C。活动期

解析：本题考查营养性维生素D缺乏性佝偻病。常规体检发现，7个月小儿头部为方颅，属于维生素D缺乏性佝偻病的活动期（C对）。营养性维生素D缺乏性佝偻病在临床上可分为4期：1.初期（B错）（早期）：多见于6个月以内，特别是3个月以内小婴儿。多为神经兴奋性增高的表现，如易激惹、烦闹、汗多刺激头皮而摇头等。但这些并非佝偻病的特异症状，仅作为临床早期诊断的参考依据。血清25-（0H）D₃下降，PTH升高，一过性血钙下降，血磷降低，碱性磷酸酶正常或稍高；此期常无骨骼病变，骨骼X线可正常，或钙化带稍模糊。2.活动期（激期）：早期维生素D缺乏的婴儿未经治疗，继续加重，出现PTH功能亢进和钙、磷代谢失常的典型骨骼改变，表现部位与该年龄骨骼生长速度较快的部位相一致。6月龄以后，尽管病情仍在进展，但颅骨软化消失。正常婴儿的骨缝周围亦可有压乒乓球样感觉。额骨和顶骨中心部分常常逐渐增厚，至7～8个月时，变成“方盒样”头型即方头（从上向下看），头围也较正常增大。3.恢复期（D错）：以上任何期经治疗及日光照射后，临床症状和体征逐渐减轻或消失。血钙磷逐渐恢复正常，碱性磷酸酶约需1～2个月降至正常水平。治疗2～3周后骨骼X线改变有所改善，出现不规则的钙化线，以后钙化带致密增厚，骨骺软骨盘＜2mm，逐渐恢复正常。4.后遗症期（E错）：多见于2岁以后的儿童。因婴幼儿期严重佝偻病，残留不同程度的骨骼畸形。无任何临床症状，血生化正常，X线检查骨骼干骺端病变消失。